欲比较某药三个不同剂量水平对某病的疗效，宜选用的假设检验方法是
A. 四格表资料的χ²检验
B. 成组资料的t检验
C. 行×列表资料的χ²检验
D. 秩和检验
E. 方差分析

正确答案：C。行×列表资料的χ²检验